在两牙接触区周围均有向四周展开的呈Ⅴ形的空隙为
A. 外展隙
B. 邻间隙
C. 楔状缺损
D. 缺牙间隙
E. 灵长间隙

正确答案：A。外展隙

解析：本题考查外展隙的定义。外展隙（A对），又称楔状隙，为在两牙接触区周围向四周展开的呈V字形的空隙。唇（颊）楔状隙和舌楔状隙分别为在唇（颊）、舌侧的空隙；切楔状隙和牙合楔状隙分别为在切、牙合方的空隙；邻间隙（B错）为在龈方的空隙。楔状缺损（C错）为牙颈部硬组织缓慢消耗而形成的缺损。缺牙间隙（D错）为牙缺失而导致的间隙。灵长间隙（E错）为位于上颌乳侧切牙与乳尖牙之间，下颌乳尖牙与第一乳磨牙之间的间隙。